患儿，女，3岁。生后发现口唇青紫，活动后加剧。平时喜蹲踞，哭吵时有突发呼吸急促、青紫加重，严重时伴晕厥，曾半年内晕厥2次，均于清晨或哭吵后发作，经2～3分钟自行恢复。今晨又出现晕厥，持续5分钟，即来急诊。查体：T37.0℃，P100次/分，R22次/分，BP82/55mmHg。神志不清，双肺听诊未见异常，胸骨左缘第2～4肋间闻及3/6级收缩期杂音，无震颤，肺动脉第二心音减弱。口唇青紫，指、趾甲青紫，杵状指、趾，颈软，神经系统查体无异常。下列抢救措施中不合适的是
A. 静脉滴注碳酸氢钠
B. 静脉注射普萘洛尔
C. 皮下注射吗啡
D. 取胸膝位
E. 口服普萘洛尔

正确答案：E。口服普萘洛尔

解析：女性患儿，有青紫、杵状指、趾、蹲踞及阵发性缺氧发作的表现。神志不清，双肺听诊未见异常，胸骨左缘第2～4肋间闻及3/6级收缩期杂音（肺动脉狭窄表现），无震颤，肺动脉第二心音减弱。综合患者的症状、体征和辅助检查，最可能的诊断为法洛四联症。下列抢救措施中不合适的是口服普萘洛尔（E错，为本题正确答案），因为其控制心率及心肌收缩力的效果劣于静脉注射普萘洛尔。静脉滴注碳酸氢钠（A对）可纠正酸中毒。静脉注射普萘洛尔（B对）、皮下注射吗啡（C对）可控制心率及心肌收缩力。取胸膝位（D对）可缓解缺氧症状。